细胞色素在呼吸链中传递电子的顺序是
A. a→a3→b→c→c1
B. a3→b→c→c1→a
C. b→c→c1→aa3
D. b→c1→c→aa3
E. c1→c→aa3→b

正确答案：D。b→c1→c→aa3